固体分散物的制备方法包括
A. 溶剂法
B. 熔融法
C. 研磨法
D. 相分离-凝聚法
E. 重结晶法

正确答案：A、B、C。溶剂法；熔融法；研磨法